阻塞后引起左心室侧壁梗死
A. 前室间支
B. 后室间支
C. 左心室后支
D. 旋支
E. 动脉圆锥支

正确答案：D。旋支

解析：旋支（D对）阻塞后可引起左心室侧壁、左房、左室前壁一小部分、左室后壁的一部或大部梗死。